下列哪种说法是正确的
A. 灵敏度也称真阳性率
B. 灵敏度也称真阴性率
C. 灵敏度也称假阳性率
D. 灵敏度也称假阴性率
E. 灵敏度也称符合率

正确答案：A。灵敏度也称真阳性率

解析：本题考查灵敏度。灵敏度也称真阳性率（A对BCDE错），即实际患病且被筛检试验标准判断为阳性的百分比，它反映了筛检试验发现病人的能力。